“冬伤于寒，春必病温”其发病类型是
A. 感而即发
B. 继发
C. 伏而后发
D. 复发
E. 徐发

正确答案：C。伏而后发

解析：伏而后发，指感邪之后，邪藏体内，逾时而发的发病类型。这种发病形式多见于外感病和某些外伤病，如“冬伤于寒，春必温病”就是伏而后发的类型（C对）。感邪即发，又称为卒发、顿发，指机体感受病邪后，随即发病。常见于外感六淫、部分病气、中毒、外伤及虫兽伤、情志过激等所致的疾病（A错）。继发，指在原发疾病未愈的基础上继而发生新的疾病，继发病必以原发病为前提，二者取系密切（B错）。复发，指疾病已愈，在病因或诱因的作用下，再次发病（D错）。徐发，徐缓而病的发病类型，多见于内伤邪气致病（E错）。